输卵管妊娠应立即手术的治疗是
A. 阴道持续出血
B. 休克
C. 后穹隆穿刺抽出血液
D. 妊娠试验阳性
E. 一侧附件扪及包块

正确答案：B。休克

解析：异位妊娠时，若出现休克征象，应在积极纠正休克的同时立即手术，如不紧急手术的话，仍有腹腔内出血，则休克难以纠正。掌握“异位妊娠”知识点。